关于红外线的叙述哪一项是错误的
A. 红外线是太阳辐射波长最长的一种电磁波
B. 红外线主要生物学作用是使机体产生热效应
C. 红外线可促进新陈代谢，有消炎、镇痛作用
D. 红外线为可见的红光
E. 过量的红外线照射可引起皮肤烧伤、白内障及中暑

正确答案：D。红外线为可见的红光

解析：本题考查红外线的相关内容。红外线是太阳辐射波长最长的一种电磁波（A对），它介于可见光和微波之间，肉眼看不见，属于不可见光（D错，为本题正确答案）。红外线的生物学作用基础是热效应（B对），适量的红外线可促进人体新陈代谢和细胞增殖，具有消炎和镇静作用（C对）；过量的红外线照射可引起皮肤烧伤、白内障及中暑等（E对）。